抑制NA释放，促进NA再摄取的药物是
A. 氟硝西泮
B. 奋乃静
C. 碳酸锂
D. 氟西汀
E. 氟哌啶醇

正确答案：C。碳酸锂

解析：本题考查碳酸锂的作用机制。碳酸锂（C对）主要通过抑制去甲肾上腺素和多巴胺的释放，促进神经细胞对去甲肾上腺素的再摄取，起到抗躁狂的作用。